不参与脑供血的动脉是
A. 大脑前动脉
B. 大脑后动脉
C. 基底动脉
D. 颈内动脉
E. 颈外动脉

正确答案：E。颈外动脉

解析：脑的动脉来源于颈内动脉（D错）和椎动脉，左、右椎动脉入颅后很快合并成一条基底动脉（C错）。大脑前动脉（A错）属于颈内动脉的分支。大脑后动脉（B错）属于基底动脉的分支。不参与脑供血的动脉是颈外动脉（E对）。